男，34岁。近1个月来多次因阵发性恐惧、胸闷、濒死感在医院急诊科就诊，症状持续约半小时后消失。多次查血常规心电图及头颅CT等未见明显异常。患者为此担心苦恼，但仍能坚持工作。该患者的主要症状是
A. 心前区疼痛
B. 急性焦虑发作
C. 慢性焦虑
D. 高血压危象
E. 转换症状

正确答案：B。急性焦虑发作

解析：该男性患者近1个月来反复出现阵发性恐惧、胸闷、濒死感，持续时间半小时左右，为急性焦虑性发作（惊恐发作）的临床症状（B对）。慢性焦虑（广泛性焦虑障碍）以焦虑为主要临床表现，患者没有明确对象的焦急、紧张和恐惧，而少有惊恐发作的典型表现（胸闷濒死感）（C错）。既往体健，血常规心电图及头颅CT等未见明显异常，故排除心血管疾病（E错）。